产后肢体关节疼痛，屈伸不利，痛无定处。其证候是
A. 血瘀
B. 风寒
C. 肾虚
D. 血虚
E. 气虚

正确答案：B。风寒

解析：血瘀证以产后身痛，尤见下肢疼痛、麻木、发硬、重着、肿胀明显，屈伸不利，小腿压痛为特点（A错）。风寒证以产后肢体关节疼痛，屈伸不利，或痛无定处，或冷痛剧烈，宛如针刺，得热则舒，或关节肿胀，麻木，重着，伴恶寒怕风为特点（B对）。肾虚证以产后腰膝、足跟疼痛，艰于俯仰为特点（C错）。血虚证以产后遍身关节酸楚、疼痛，肢体麻木；面色萎黄，头晕心悸为特点（D错）。产后身痛无气虚证（E错）。